咽峡
A. 是口腔和咽的分界处
B. 由腭舌弓和腭咽弓所围成
C. 是咽与喉咽的分界处
D. 由腭帆后缘、两侧腭咽弓和舌根围成
E. 是鼻腔与咽的分界处

正确答案：A。是口腔和咽的分界处

解析：咽峡为口腔和咽的分界处(A对CE错)，由腭垂、腭帆游离缘、两侧的腭舌弓及舌根围成(BD错)。